以下关于复发性腮腺炎的描述中，正确的是
A. 具有自愈性
B. 要防止继发感染
C. 需增强抵抗力
D. 以减少发作为原则
E. 以上说法均正确

正确答案：E。以上说法均正确

解析：复发性腮腺炎具有自愈性，以增强抵抗力、防止继发感染，减少复发作为原则。掌握“慢性复发性腮腺炎”知识点。